与子痫发生无关的是
A. 双胎妊娠
B. 糖尿病
C. 羊水过多
D. 前置胎盘
E. 营养不良

正确答案：D。前置胎盘

解析：糖尿病（P76）（B错）羊水过多发生率较非糖尿病孕妇多10倍，与胎儿高血糖、高渗性利尿致胎尿排出过多有关，而羊水过多（P137）（C错）、双胎妊娠（P123）（A错）时子宫张力增高，孕妇易并发妊娠期高血压疾病。营养不良（P65）（E错）如低白蛋白血症、钙、镁、锌、硒等缺乏与先兆子痫的发生有关。前置胎盘（P128）（D对）可引起产时、产后出血，植入性胎盘，产褥感染，与先兆子痫（子痫前期）的发生无关。